下列对开放性气胸的紧急处理措施中，首先要采取的是
A. 立即行气管内插管呼吸器辅助呼吸
B. 立即面罩给氧
C. 立即行清创术
D. 立即用无菌不透气材料覆盖包扎伤口
E. 立即行胸腔闭式引流术

正确答案：D。立即用无菌不透气材料覆盖包扎伤口

解析：开放性气胸需先变为闭合性气胸。用无菌敷料封盖伤口，再用胶布或绷带包扎固定。然后胸穿抽气。掌握“气胸”知识点。